根尖1/3处折断的患牙处理为
A. 固定并定期观察
B. 冠修复
C. 不治疗
D. 牙髓治疗
E. 定期观察

正确答案：A。固定并定期观察

解析：本题考查根尖1/3处折断的治疗。根尖1/3处折断的患牙处理为固定并定期观察（A对）。1.根折的治疗首先应是促进其自然愈合，即使牙似乎很稳固，也应尽早用夹板固定，以防活动。除非牙外伤后已数周才就诊，而松动度又较小就不必固定。2.对根尖1/3折断，在许多情况下只行夹板固定，无需牙髓治疗，有可能出现修复并维持牙髓活力，那种认为根折牙应进行预防性牙髓治疗的观点是不正确的。因为根折后立即进行根管治疗常有可能把根管糊剂压入断端之间，反而影响其修复。但当牙髓有坏死时，则应迅速进行根管治疗术。